支配眼球的副交感纤维完全麻痹时
A. 上睑下垂
B. 瞳孔缩小
C. 瞳孔散大
D. 眼球斜向外下方
E. 无

正确答案：C。瞳孔散大

解析：动眼神经含一般躯体运动纤维及一般内脏（副交感）纤维。一般躯体运动纤维支配同侧上睑提肌、上直肌、内直肌、下直肌、下斜肌，该纤维损伤时出现上睑下垂（A错）、眼球斜向外下方（D错）表现。副交感纤维进入睫状神经节换元，节后纤维加入睫状短神经进入眼球，支配瞳孔括约肌、睫状肌，因而支配眼球的副交感纤维完全麻痹时出现瞳孔括约肌麻痹，瞳孔散大（C对）。若一侧颈上交感神经径路损害如Horner综合征使睫状神经节内交感根功能障碍，则出现瞳孔开大肌瘫痪，瞳孔缩小（B错）。